患者，男，50岁，2周前发现右下后牙龈有小包。平时无明显不适，曾在外院照X片。查见右下第一前磨牙咬合面龋洞深，探无感觉，叩诊异常感。右下第一磨牙近中根尖部龈瘘管。X片见右下第一前磨牙根尖X线透射区不规则，边界模糊，右下第三磨牙前倾阻生，余未见异常。主诉牙应是
A. 右下第一前磨牙
B. 右下第二前磨牙
C. 右下第一磨牙
D. 右下第二磨牙
E. 右下第三磨牙

正确答案：A。右下第一前磨牙

解析：本题考查慢性根尖周炎。此题解题的关键是在题干提示的X线表现“X片见右下第一前磨牙根尖X线透射区不规则”，瘘管的位置不能表示患牙的位置，依据X线表现，推断主诉牙为右下第一前磨牙（A对）。